与掌浅弓无关的血管是
A. 拇主要动脉
B. 尺动脉末端
C. 桡动脉掌浅支
D. 指掌侧总动脉
E. 小指尺掌侧动脉

正确答案：A。拇主要动脉

解析：拇主要动脉（A错，为本题正确答案）为桡动脉的主要分支，与掌浅弓无关。尺动脉末端（B对）与桡动脉的掌浅支（C对）吻合形成掌浅弓。掌浅弓发出指掌侧总动脉（D对）和小指尺掌侧动脉（E对）。